已知肛门栓模具的装量为2g，苯巴比妥的置换价为0.8。现有苯巴比妥4g，欲制成20枚栓剂，需可可豆脂
A. 25g
B. 30g
C. 35g
D. 40g
E. 45g

正确答案：C。35g